反治法属于
A. 治病求本
B. 未病先防
C. 既病防变
D. 因地制宜
E. 因时制宜

正确答案：A。治病求本

解析：反治法顺从病证的假象，与证候本质相反（A对）；未病先防、既病防变属于治未病的两个方面，不属于治疗原则（BC错）；因地制宜、因时制宜是三因制宜的两个方面，和反治法没有关联（DE错）。